地榆与白茅根均能凉血止血，地榆又能
A. 解毒敛疮
B. 活血止痛
C. 清热利尿
D. 化瘀止血
E. 祛痰止咳

正确答案：A。解毒敛疮

解析：本题考查的是地榆的功效。地榆与白茅根均能凉血止血，地榆又能解毒敛疮（A对）。地榆：【功效】凉血止血，解毒敛疮。三七：【功效】化瘀止血（D错），活血定痛（B错）。白茅根：【功效】凉血止血，清热生津，利尿（C错）通淋。侧柏叶：【功效】凉血止血，祛痰止咳（E错），生发乌发。